叶天士所述“入营犹可透热转气”是指
A. 凉营药中伍以滋阴凉血之品
B. 凉营药中伍以辛凉解毒之品
C. 凉营药中伍以辛寒清气之品
D. 凉营药中伍以轻清透泄之品
E. 凉营药中伍以泻实攻下之品

正确答案：D。凉营药中伍以轻清透泄之品

解析：“入营犹可透热转气”是指温邪入营，但未见动血耗血之象，此时可用犀角、玄参、羚羊角等清营热、滋营阴，同时佐以轻清透泄之品，银花、连翘、竹叶等引营分邪热透出气分而解（D对）。